下列有关应用糖皮质激素治疗乙脑的叙述，错误的是
A. 有抑制免疫作用
B. 重症患者可短期使用
C. 疗效肯定
D. 有退热作用
E. 可减轻脑水肿

正确答案：C。疗效肯定

解析：目前对激素的使用还没有统一的意见。有人认为疗效不显著，不主张常规使用（C对）。糖皮质激素抑制机体的免疫功能（A错），增加继发感染机会；临床上可根据具体情况在重症患者的抢救中酌情使用（B错）；有抗炎、退热作用（D错）；有防治脑水肿作用（E错）。